男，38岁。肛周皮下有一深部脓肿，一边向体表穿破，另一端向直肠穿孔，不断有脓粪液流出。此管道应称为
A. 空洞
B. 溃疡
C. 蜂窝织炎
D. 窦道
E. 瘘管

正确答案：E。瘘管

解析：瘘管是连接两个内脏器官或从内脏器官通向体表的通道样缺损。该患者肛周皮下深部脓肿，一端向体表穿破，另一端向直肠穿孔，说明此管道为连接直肠与体表的管道，此管道应为瘘管（E对）。肺、肾等内脏坏死物液化后，经支气管、输尿管等自然管道排除，所残留的空腔为空洞（A错）。较深的组织缺损称为溃疡（B错）。蜂窝织炎（C错）为疏松结缔组织的弥漫性化脓性炎，不会形成管道。组织坏死后形成的只开口于皮肤黏膜表面的深在性盲管是窦道（D错），一般只有外口。